临床少见而产妇病死率极高的分娩期并发症是
A. 子痫
B. 脐带脱垂
C. 子宫破裂
D. 产后出血
E. 羊水栓塞

正确答案：E。羊水栓塞

解析：羊水栓塞是指在分娩过程中羊水突然进入母体血液循环引起急性肺栓塞，过敏性休克，弥散性血管内凝血，肾功能衰竭或猝死的严重的分娩期并发症，发病率为4/10万～6/10万，而死亡率高达60%以上（E对）。临床少见而产妇病死率极高的分娩期并发症是羊水栓塞。子痫（A错）、子宫破裂（C错）、产后出血（D错）是导致孕产妇死亡的主要原因，但均较常见。脐带脱垂（B错）不是分娩期并发症。